关于房水的描述，错误的是
A. 充满于角膜与晶状体之间腔隙中
B. 有维持眼内压的作用
C. 除屈光作用外，还有营养角膜和晶状体的作用
D. 其循环途径是眼后房→瞳孔→虹膜角膜角→前房→巩膜静脉窦，最后汇入眼静脉
E. 房水产生过多或循环受阻,可导致青光眼

正确答案：D。其循环途径是眼后房→瞳孔→虹膜角膜角→前房→巩膜静脉窦，最后汇入眼静脉

解析：房水充满于角膜与晶状体之间腔隙（即眼房）中（A对），有维持眼内压的多用（B对），屈光作用，还有营养角膜和晶状体的作用（C对），其循环途径是眼后房→瞳孔→前房→虹膜角膜角→巩膜静脉窦，最后汇入眼静脉（D错，为本题正确答案）。房水过多或循环受阻，可导致青光眼（E对）。